女性，22岁，因右下智齿低位埋伏阻生，要求拔除。为减少出血，保持术野清晰，常在麻约中加入肾上腺素，拔除该牙应麻醉的神经是同侧的
A. 下牙槽神经+舌神经
B. 下牙槽神经+颊神经
C. 颊神经+舌神经
D. 腭神经+舌神经+颊神经
E. 下牙槽神经+颊神经+舌神经

正确答案：E。下牙槽神经+颊神经+舌神经

解析：本题考查上、下颌神经在口腔的分布。女性，22岁，因右下智齿低位埋伏阻生，要求拔除。为减少出血，保持术野清晰，常在麻药中加入肾上腺素，拔除该牙应麻醉的神经是同侧的下牙槽神经+颊神经+舌神经（E对）。舌神经支配48的舌侧牙龈和口底；颊神经支配48颊侧牙龈、颊部皮肤和黏膜；下牙槽神经支配48牙髓、牙周膜及牙槽骨。所以拔除48需麻醉的神经是下牙槽神经+颊神经+舌神经。